患者，男，65岁，患高血压病多年，近三年来一直服用氨氯地平和阿替洛尔，血压控制良好。近期因治疗肺结核，服用利福平、乙胺丁醇，两周后血压升高。引起血压升高的原因可能是
A. 利福平促进了阿替洛尔的肾脏排泄
B. 利福平诱导了肝药酶，促进了氨氯地平的代谢
C. 乙胺丁醇促进了阿替洛尔的肾脏排泄
D. 乙胺丁醇诱导了肝药酶，促进了氨氯地平的代谢
E. 利福平与氨氯地平结合成难溶的复合物

正确答案：B。利福平诱导了肝药酶，促进了氨氯地平的代谢

解析：本题考查酶诱导与酶抑制。利福平诱导了肝药酶，促进了氨氯地平的代谢（B对）；利福平属于肝药酶诱导剂，酶的诱导可以增加肝药酶活性，加速代谢，使受影响的药物作用减弱或缩短；乙胺丁醇对结核杆菌和其它分支杆菌有较强的抑制作用（CD错）。